一患者，体温骤升至39℃，持续4天后骤降至正常水平，发热与体温正常各持续4～5天即交替一次，应考虑的疾病是
A. 败血症
B. 疟疾
C. 周期热
D. 伤寒
E. 重症肺结核

正确答案：C。周期热

解析：凡是体温突然或缓慢上升达到高峰，保持一定时间，然后迅速或缓慢下降至正常；经过一定时间的无热期后再发热，历经一定时间后又下降至正常体温。这种发热期与无发热期交替出现，反复多次，即为周期性发热（C对）；败血症、重症肺结核常表现为弛张热，又称败血症热型。体温持续在39℃以上，24 h内波动范围达2℃以上，但均高于正常体温（AE错）；疟疾常表现为间歇热，即高热期与无热期交替出现，体温骤升达高峰后持续数小时，又迅速降至正常水平，无热期（间歇期）持续1日至数日，如此反复交替（B错）；伤寒表现为稽留热，即体温持续在39～40℃以上的高水平，达数日或数周。24h内体温波动范围不超过1℃（D错）。